艾滋病患者晚期淋巴结的病理变化特点
A. 淋巴滤泡增生
B. 副皮质区增生
C. 窦组织细胞增生
D. 淋巴细胞消失殆尽
E. 副皮质区变窄

正确答案：D。淋巴细胞消失殆尽

解析：艾滋病患者的病理变化过程主要是：早期，淋巴结肿大，淋巴滤泡增生（A错），生发中心活跃。随着病情发展，滤泡外层淋巴细胞减少或消失，副皮质区CD4⁺T细胞进行性减少，小血管增生，生发中心被零落分割。晚期，淋巴结呈现一片荒芜，副皮质区（BE错）及淋巴滤泡消失，淋巴细胞几乎消失殆尽（D对），仅残留少许巨噬细胞和浆细胞。窦组织细胞增生（C错）见于罗道病（Rosai-Dorfman病），后者是一种良性淋巴组织增生性疾病，与艾滋病无关。